下列哪项不属于可吸收性GTR生物相容性膜材料
A. 聚合胶原膜
B. 聚四氟乙烯
C. 聚乳酸膜
D. 乳酸-乙酸共聚膜
E. 以上均是

正确答案：B。聚四氟乙烯

解析：本题考查可吸收性GTR生物相容性膜材料。不可吸收性膜在人体内不能降解吸收，聚四氟乙烯（B错，为本题的正确答案）属于不可吸收性膜。GTR即引导性组织再生术，在牙周手术中需利用可吸收性或不可吸收性GTR生物相容性膜材料作为屏障，引导具有形成新附着能力的牙周膜细胞优先占领根面 ，从而形成牙周组织的再生。可吸收性膜在手术愈合过程中可降解而被吸收，不需要二次手术取出。这类膜有胶原膜（A对）、聚乳酸膜（C对）、聚乙醇酸与聚乳酸和碳酸三甲烯共聚膜包括乳酸-乙酸共聚膜（D对）等。